下列有关中耳鼓室的描述,不正确的是
A. 盖壁骨板较薄，故中耳炎症可侵入颅内
B. 向后经乳突窦口通乳突窦及乳突小房，故鼓室的炎症可侵入乳突深部
C. 内侧壁，岬的后上方有前庭窗，直接与耳蜗的前庭阶相通
D. 内侧壁，岬的后下方有蜗窗，被第二鼓膜封闭，不直接与耳蜗的鼓阶相通
E. 缺乏皮下组织，皮肤与骨(及软骨)膜紧密结合，炎症肿胀时疼痛明显

正确答案：C。内侧壁，岬的后上方有前庭窗，直接与耳蜗的前庭阶相通

解析：盖壁向后延伸形成乳突窦的上壁。中耳疾患时可侵犯此壁，引起耳源性颅内并发症（A对）。中耳炎可经乳突窦侵犯乳突小房而引起乳突炎（B对）。岬的后上方有一卵圆形小孔，称前庭窗或卵圆窗，通向前庭。在活体，由镫骨底及其周缘的韧带将前庭窗封闭（C错，为本题正确答案）。岬的后下方有一圆形小孔，称蜗窗或圆窗，在活体上由第二鼓膜封闭（D对）。因皮下组织少，皮肤与软骨膜、骨膜结合紧密，不易移动，故外耳道皮肤疖肿时，疼痛剧烈”（E对，但这是描述外耳道的，与题干不符合）